《中国药典》规定，肿节风含量测定的指标成分是
A. 异嗪皮啶
B. 阿魏酸
C. 莪术醇
D. 柴胡皂苷d
E. 葛根素

正确答案：A。异嗪皮啶

解析：本题考查的是肿节风含量测定的指标成分。《中国药典》规定，肿节风含量测定的指标成分是异嗪皮啶（A对）。肿节风主要含有酚类、鞣质、黄酮苷、香豆素和内酯类化合物。其中香豆素类主要包括异嗪皮啶、东莨菪内酯等。药理实验已经证明这些化学成分（或有效部位）本身有一定的抗菌、消炎、镇痛和抗肿瘤活性。《中国药典》采用高效液相色谱法测定药材中异嗪皮啶和迷迭香酸含量，其中异嗪皮啶含量不得少于0.020%，迷迭香酸含量不得少于0.020%。药材储藏于通风干燥处。阿魏酸（B错）为当归含量测定的指标成分之一。当归有机酚酸的化学结构：当归中主要含有机酸类成分、挥发油和多糖类成分。有机酸类成分主要包括阿魏酸、香草酸、烟酸和琥珀酸等。《中国药典》以阿魏酸和挥发油为指标成分进行含量测定，要求阿魏酸含量不得少于0.050%，挥发油含量不得少于0.4%（ml/g）。莪术醇（C错）为莪术的主要有效成分之一。莪术含挥发油1.0%～2.5%，《中国药典》规定原药材含挥发油不得少于1.5%（ml/g），饮片含挥发油不得少于1.0%（ml/g）。其中吉马酮、莪术醇、莪术二醇、莪术酮及莪术二酮等为倍半萜类化合物，是莪术挥发油的主要有效成分。柴胡皂苷d（D错）为柴胡药材含量测定的指标成分之一。柴胡中含有的总皂苷为1.6%～3.8%。柴胡中所含皂苷均为三萜皂苷，柴胡皂苷是柴胡的主要有效成分。《中国药典》以柴胡皂苷a和柴胡皂苷d为指标成分对柴胡药材进行含量测定。要求两者的总含量不少于0.30%。葛根素（E错）为葛根含量测定的指标成分。葛根含异黄酮类化合物，主要成分有大豆素、大豆苷、大豆素-7,4'-二葡萄糖苷及葛根素、葛根素-7-木糖苷。《中国药典》以葛根素为指标成分进行含量测定，要求含葛根素不得少于2.4%。